患者咳嗽，查体：气管向左偏移，右侧胸廓较左侧饱满，叩诊时出现鼓音。应首先考虑的是
A. 右侧气胸
B. 左侧肺不张
C. 右下肺炎
D. 肺气肿
E. 右侧胸腔积液

正确答案：A。右侧气胸

解析：本例患者有咳嗽病史，查体可发现气管向左偏移、右侧胸廓较左侧饱满且叩诊出现鼓音，诊断首先考虑的是右侧气胸（A对）。左侧肺不张（B错）患者气管向左偏移，左侧胸廓平坦，叩诊出现浊音。右下肺炎（C错）患者气管居中，胸廓多对称，叩诊可出现浊音。肺气肿（D错）患者气管多居中，胸廓可呈桶状，叩诊出现过清音。右侧胸腔积液（E错）患者气管向左偏移，右侧胸廓饱满，叩诊出现实音。